嘌呤含量最高的酒类是
A. 普通黄酒
B. 啤酒
C. 白酒
D. 陈年黄酒
E. 红酒

正确答案：D。陈年黄酒

解析：本题考查嘌呤含量最高的酒类。嘌呤含量依酒精饮料种类不同而各异，一般规律为：陈年黄酒＞啤酒＞普通黄酒＞白酒（D对ABCE错）。